根据2013年1月发布的《药品经营质量管理规范》，购销记录保存的时限应当是
A. 至少1年
B. 至少2年
C. 至少3年
D. 至少4年
E. 至少5年

正确答案：E。至少5年

解析：本题考查药品经营质量管理规范。新版《药品经营质量管理规范》要求所有的记录和凭证保存至少5年（E对）。